头痛病因中属颅外疾病是
A. 癔症
B. 中暑
C. 偏头痛
D. 三叉神经痛
E. 神经衰弱

正确答案：D。三叉神经痛

解析：属颅外疾病是三叉神经痛（D对）。偏头痛属于颅内病变（C错）。癔症属于精神障碍疾病或心理障碍（A错）。中暑是指由于体温过高和体内热量过度积聚而导致的体温调节功能障碍，从而对神经器官造成损伤，属全身疾病（B错）。神经衰弱为神经症（E错）。